显微鉴别可见钟乳体的是
A. 薄荷
B. 穿心莲
C. 青蒿
D. 茵陈
E. 石斛

正确答案：B。穿心莲

解析：本题考查的是穿心莲的显微鉴别。显微鉴别可见钟乳体的是穿心莲（B对）。穿心莲【显微鉴别】粉末上下表皮均有增大的晶细胞，内含大型螺状钟乳体，较大端有脐样点痕，层纹波状。下表皮气孔直轴式，副卫细胞大小悬殊，少数为不定式。另有腺鳞和非腺毛。薄荷（A错）【显微鉴别】叶表面制片或粉末：①腺鳞的腺头呈扁圆球形，由8个分泌细胞排列成辐射状，腺头外围有角质层，与分泌细胞的间隙处有浅黄色油质，腺柄单细胞，极短，四周表皮细胞做放射状排列。②表皮细胞壁薄，呈微波状，上、下表皮有直轴式气孔，以下表皮为多。③小腺毛为单细胞头，单细胞柄。④非腺毛略弯曲，壁厚，有疣状突起。青蒿（C错）【显微鉴别】通过最终裂片的中脉横切面：①表皮细胞1列，长椭圆形，排列紧密，可见有气孔、丁字毛及腺毛。②叶肉组织等面型。③上面栅栏组织细胞延续至中脉，下面于中脉处中断。④维管束位于中心。茵陈（D错）【显微鉴别】茵陈蒿叶粉末：①上表皮细胞壁较平直，下表皮细胞垂周壁波状弯曲。②上、下表皮均有不定式气孔。③腺毛少，顶面观呈鞋底形，常充满淡黄色油状物质，上下表面无明显差异。④表面密布“T”字形非腺毛，具柄部及单细胞臂部；臂细胞直线延伸，两臂不等长，中部略折成“V”字形，细胞壁厚，胞腔常呈细缝状，柄1～2细胞，极短。石斛（E错）【显微鉴别】横切面：鼓槌石斛①表皮细胞扁平，外壁及侧壁增厚，胞腔狭长形；角质层淡黄色。②基本组织细胞大小差异较显著。多数外韧型维管束略排成10～12圈。③木质部导管大小近似。④有的可见含草酸钙针晶束细胞。